药物在体内达到动态平衡时，体内药量与血药浓度的比值称为
A. t1/2
B. 生物利用度
C. 表观分布容积
D. 清除率
E. 达峰时间

正确答案：C。表观分布容积

解析：本题考查表观分布容积。表观分布容积（C对）是指药物在体内达到动态平衡时，体内药量与血药浓度的比值；t1/2（A错）为消除半衰期，是指血药浓度下降一半所需的时间；生物利用度（B错）是指药物经血管外途径给药后吸收进入全身血液循环的相对量；清除率（D错）是指单位时间从体内消除的含药血浆体积；达峰时间（E错）指单次服药后，血药浓度达到峰值的时间。